女性，38岁。Graves病甲状腺次全切除术后10年。近4个月心慌、怕热、多汗、手颤抖，体重下降5kg。血TSH、PT₃、FT₄检查证实甲亢复发，服他巴唑2周后因严重药疹而停药。下一步治疗应
A. 他巴唑加抗过敏药物
B. 改用丙基硫氧嘧啶
C. 改用β受体阻滞剂
D. 再次手术治疗
E. 用核素¹³¹I治疗

正确答案：E。用核素¹³¹I治疗

解析：患者Graves病甲状腺次全切除术后10年，出现心慌、怕热多汗、手抖、消瘦等甲亢复发表现，使用药物治疗后出现严重药疹，无¹³¹I治疗的禁忌，因此首选治疗应为核素¹³¹I治疗（E对）。Graves病常用药物包括硫脲类（如丙基硫氧嘧啶）和咪唑类（如他巴唑），患者出现严重皮疹，应停用药物治疗（A错），也不能换用其它抗甲状腺药物（B错）。β受体阻滞剂（P687）（C错）不能减少甲状腺激素合成和释放，主要用于甲亢确诊前对症治疗或抗甲状腺药物治疗的辅助治疗。患者手术后甲亢复发，不提倡手术治疗（D错），因手术已造成甲状腺与周围组织粘连，难以分离，易损伤神经与动脉。